对拟杆菌属等厌氧菌具有抗菌活性，属于头霉素类抗菌素类药是
A. 头孢吡肟
B. 头孢美唑
C. 亚胺培南
D. 氨曲南
E. 拉氧头孢

正确答案：B。头孢美唑

解析：本题考查头霉素类抗菌素类药。头孢美唑（B对）对拟杆菌属等厌氧菌具有抗菌活性，属于头霉素类抗菌素类药。亚胺培南（C错）为碳青霉烯类。氨曲南（D错）为单酰胺菌素类。拉氧头孢（E错）为氧头孢烯类。